在公立医疗机构药品采购中，国家对临床必需、用量小、市场供应短缺的基本药物实施定点生产试点工作。关于定点生产品种管理的说法，错误的是
A. 非政府办医疗卫生机构应按照统一价格采购使用定点生产品种
B. 定点生产企业按照所划分的区域，直接在省级集中采购平台上挂网销售相应品种
C. 政府办基层医疗卫生机构应当委托省级药品采购机构按照统一价格，从定点生产企业集中采购、集中支付货款
D. 公立医院应优先按照统一价格从定点生产企业采购相应品种

正确答案：A。非政府办医疗卫生机构应按照统一价格采购使用定点生产品种

解析：本题考查的是国家定点生产的药品。鼓励其他医疗卫生机构采购使用定点生产品种（A错，为本题正确答案）。国家定点生产的药品：对临床必需、用量小、市场供应短缺的药品，由国家招标定点生产、议价采购。根据《关于2016年临床必需、用量小、市场供应短缺药品定点生产试点有关事项的通知》（国卫药政函〔2016〕365号），目前已完成地高辛口服溶液、复方磺胺甲唑注射液、注射用对氨基水杨酸钠3个品种的定点生产企业招标工作。定点生产企业按照所划分的区域，直接在省级集中采购平台上挂网销售相应品种（B对）。政府办基层医疗卫生机构使用的定点生产品种，应当委托省级药品采购机构按照统一价格，从定点生产企业集中采购、集中支付货款（C对）；公立医院也应当按照统一价格从定点生产企业采购相应品种（D对）；鼓励其他医疗卫生机构采购使用定点生产品种。